关于菌斑说法正确的是
A. 各部位菌斑结构无显著差异
B. 同一口腔菌斑内细菌无显著差异
C. 菌斑由粘性基质和嵌入其中的细菌构成
D. 基质主要成分为唾液糖蛋白、细菌的胞内聚合物
E. 在菌斑-牙界面层，细菌呈扇贝状直接附于釉质

正确答案：C。菌斑由粘性基质和嵌入其中的细菌构成

解析：本题考查细菌和菌斑。菌斑主要由菌斑基质和嵌入其中的细菌构成（C对）。各部位的牙菌斑结构有显著的差异（A错）。由于细菌附着的复杂性，同一口腔不同部位的菌斑细菌种类和数量不同（B错）。基质主要成分为唾液糖蛋白，细菌的胞外聚合物（D错），细菌附着在基质中。在菌斑-牙界面层，细菌呈扇贝状附于获得性膜上，而不是直接附于釉质（E错）。